心肌肥大的不平衡生长导致心衰的原因是
A. 心肌细胞体积过度增大
B. 心肌细胞重量过度增加
C. 心肌细胞表面积相对不足
D. 心肌细胞表面积过度增加
E. 心肌重量的增加与心功能的增加不成比例

正确答案：E。心肌重量的增加与心功能的增加不成比例

解析：心肌肥大不平衡生长时，心肌肌丝的增加导致重量的增加，而心肌的线粒体无法成比例增加，使心肌能量代谢障碍。另外，心肌肌丝不规则的叠加使肌原纤维排列紊乱，心肌能量代谢障碍、肌原纤维排列紊乱均最终导致心肌收缩力降低，造成心功能减退。因而心肌肥大的不平衡生长导致心衰的原因是心肌重量的增加与心功能的增加不成比例（E对）。